影响核酸生物合成的抗肿瘤药物又称
A. 抗代谢药
B. 抗炎药
C. 利尿剂
D. 抗生素
E. 镇痛药

正确答案：A。抗代谢药

解析：影响核酸生物合成的抗肿瘤药物又称抗代谢药，可以通过特异性干扰核酸的代谢，阻止细胞的分裂和繁殖。掌握“抗恶性肿瘤药”知识点。